构成细菌毒力的是
A. 基本结构
B. 特殊结构
C. 侵袭力和毒素
D. 分解代谢产物
E. 侵入机体的途径

正确答案：C。侵袭力和毒素

解析：细菌的毒力是由侵袭力和毒素决定的。掌握“医院感染及细菌的致病性”知识点。